湿性坏疽常发生在
A. 脑、脾、肝
B. 脑、肠、子宫
C. 肺、肠、肝
D. 肺、肾、脑
E. 肺、肠、子宫

正确答案：E。肺、肠、子宫

解析：坏疽是指局部组织大块坏死并继发腐败菌感染，分为干性、湿性和气性等类型。其中湿性坏疽常发生在肺、肠、子宫（E对）等器官。脑常发生液化性坏死。肝、脾、肾常发生凝固性坏死。